中暑时，腓肠肌的痉挛是因为其
A. 失水过多
B. 过度紧张
C. 失盐过多
D. 体温过高
E. 热量丢失

正确答案：C。失盐过多